下列是典型心绞痛的心电图改变的是
A. 面对缺血区导联ST段水平压低≥0.1mV，T波倒置
B. 面对缺血区导联ST段抬高，T波高尖
C. 面对缺血区导联Q波加深，深度≥R波的1/4
D. 面对缺血区导联Q波加宽，宽度>0.04s
E. QRS波群宽大畸形

正确答案：A。面对缺血区导联ST段水平压低≥0.1mV，T波倒置

解析：心绞痛通常是在冠状动脉固定性严重狭窄基础上，由于心肌负荷的增加引起心肌急剧的、暂时的缺血缺氧的临床综合征，其典型的心电图改变为面对缺血区导联ST段水平压低≥0.1mV，T波倒置（A对）。面对缺血区导联ST段抬高，T波高尖可见于变异型心绞痛患者（B错）。面对缺血区导联Q波加深，深度≥R波的1/4可见于心肌梗死患者（C错）。面对缺血区导联Q波加宽，宽度﹥0.04s可见于少数心肌梗死患者（D错）。QRS波群宽大畸形可见于室性期前收缩（E错）。